关于胶囊剂的质量要求和应用注意事项的说法，正确的是
A. 软胶囊的崩解时限为30分钟
B. 除另有规定外，软胶囊应进行释放度检查
C. 中药硬胶囊内容物水分不得过12.0%
D. 胶囊应30℃以下，密闭贮存
E. 胶囊一般不宜嚼碎服用

正确答案：E。胶囊一般不宜嚼碎服用

解析：本题考查的是胶囊剂的质量要求。关于胶囊剂的质量要求和应用注意事项的说法，正确的是胶囊一般不宜嚼碎服用（E对）。胶囊剂不宜去壳服用：如果没有特殊说明，一般情况下不要把胶囊壳剥开倾出药粉服用。除非患者服用胶囊类药剂确实有困难，确需掰开服用时，应仔细阅读药品说明书或向医师、药师咨询。缓释胶囊和肠溶胶囊不可剥开服用。内容物为液体的软胶囊，嚼碎后可能导致药物成分的吸收途径发生变化，故不可嚼碎服用。胶囊剂的崩解时限：硬胶囊的崩解时限为30分钟、软胶囊的崩解时限为1小时（A错）。胶囊剂的释放度：缓释胶囊应符合缓释制剂的有关要求并应进行释放度检查；控释胶囊应符合控释制剂的有关要求并应进行释放度检查。肠溶胶囊应符合迟释制剂的有关要求，并进行释放度检查（B错）。中药硬胶囊剂应进行水分检查。除另有规定外，其内容物的水分不得过9.0%（C错），硬胶囊内容物为液体或半固体者不检查水分。除另有规定外，胶囊应密封贮存，其存放环境温度不高于30℃，湿度应适宜，防止受潮、发霉、变质。